患儿，女，6岁。左颈项结肿疼痛3天，皮色未变，肿块如鸡卵大，活动度存在，伴咽喉红肿，恶寒发热，头痛，舌苔薄黄，脉细数。内治应首选
A. 仙方活命饮
B. 牛蒡解肌汤
C. 桑菊饮
D. 五味消毒饮
E. 五神汤

正确答案：B。牛蒡解肌汤

解析：该患者左颈项结肿疼痛，皮色未变，肿块如鸡卵大，活动度存在并伴有风温外感症状，故诊断为颈痈。火毒结于少阳、阳明，经络阻塞，气血凝滞，热胜肉腐而发为颈痈。风温风热之邪，由外袭表，化火蕴结于少阳、阳明之络，故见咽喉红肿，恶寒发热，头痛。舌苔薄黄符合风热袭表的舌象，脉细数可因风热火毒伤阴所致。故辨证为风热痰毒证，治宜散风清热，化痰消肿。仙方活命饮为痈之火毒凝结证的选方（A错）。牛蒡解肌汤功能祛风清热，化痰消肿，可用于头面颈项痈毒，因风火痰所致者，为颈痈风火痰毒证的选方（B对）。桑菊饮功能疏风清热，宣肺止咳，主治风温初起，表热轻证。但咳，身热不甚者，无化痰消肿之功（C错）。五味消毒饮功能清热解毒，消散疔疮，主治疔疮初起，发热恶寒，疮形如粟，坚硬根深，状如铁钉，以及痈疡疖肿，红肿热痛（D错）。五神汤功能清利湿热，用于委中毒，附骨疽等证，由湿热凝结而成者（E错）。